男，70岁。进行性排尿困难10年，夜尿3～4次。从未药物治疗。直肠指检：前列腺体积增大，中央沟消失，表面尚光滑，质地中等。B超：双肾无积水，输尿管未见扩张。最大尿流率10ml/s。首选的治疗方法是
A. 膀胱造瘘
B. 根治性前列腺切除术
C. 口服多沙唑嗪+非那雄胺
D. 经尿道前列腺切除术（TURP）
E. 膀胱切开取石

正确答案：D。经尿道前列腺切除术（TURP）

解析：老年男性患者，进行性排尿困难（前列腺增生典型表现），直肠指检前列腺体积增大，中央沟消失，表面尚光滑，质地中等（提示可能为前列腺增生），结合患者病史、临床表现和相关检查，首先考虑的疾病是前列腺增生。患者最大尿流率10ml/s，表明梗阻严重，有手术指征，该患者尚无明显尿潴留症状，一般情况良好，故首选的手术方法是经尿道前列腺切除术（TURP）（D对）。膀胱造瘘（A错）主要用于残余尿量较多或有肾积水、肾功能不全的前列腺增生患者的术前治疗。根治性前列腺切除术（B错）主要用于前列腺癌的治疗。多沙唑嗪（α受体阻滞剂）、非那雄胺（5α还原酶抑制剂）（C错）等药物主要用于症状较轻、前列腺增生体积较小的病人。膀胱切开取石（E错）主要用于膀胱结石的治疗。